女，57岁，阴道口脱出肿物2个月。妇科：阴道可见宫颈及部分宫体，阴道前后壁均有轻度膨出。既往有高血压，糖尿病。药物控制血压、血糖较平稳。患者适合的治疗方案是
A. 放置子宫颈托
B. 阴道前后壁修补术及主韧带缩短术
C. 经阴道全子宫切除及阴道前后壁修补
D. 阴道全封闭术
E. 宫颈部分切除及阴道前后壁修补

正确答案：C。经阴道全子宫切除及阴道前后壁修补

解析：该患者女，57岁，阴道口脱出肿物2个月。妇科：阴道可见宫颈及部分宫体，阴道前后壁均有轻度膨出。既往有高血压，糖尿病。药物控制血压、血糖较平稳，结合患者的表现和辅助检查，提示为子宫脱垂，应行经阴道全子宫切除及阴道前后壁修补（C对）。子宫脱垂分度： 一度（子宫未脱出阴道口），轻型：宫颈距处女膜＜4cm，未到达处女膜缘；重型：宫颈已到达处女膜缘，阴道口可见宫颈。 二度（子宫部分脱出阴道口）：轻型：宫颈脱出阴道口，宫体仍在阴道内；重型：宫颈及部分宫体脱出阴道口。 三度（全部都掉出来了）：宫颈及宫体全部脱出阴道口外。 治疗：一度首选子宫托 二、三度首选手术治疗。 手术：年轻且宫颈较长～曼氏手术；年龄较大者～经阴道子宫全切及阴道前后壁修补；年老体弱不能耐受较大手术者～阴道封堵术。